拔髓术操作不合要求的是
A. 钻针方向与牙长轴平行
B. 由较突出的髓角处穿孔进入髓腔
C. 用球钻提拉式磨除髓顶
D. 只要暴露根管口即可
E. 以上都不对

正确答案：D。只要暴露根管口即可

解析：本题考查拔髓术的操作。开髓后应使根管器械能尽可能地循直线方向进入根管，只暴露根管口（D错，为本题的正确答案）但器械未能循直线进入根管，根管预备时根管壁有可能侧穿或产生台阶。拔髓术指通过器械将髓腔开放，在根管口暴露的情况下将根管系统内的牙髓去除的方法。开髓时钻针方向与牙长轴平行（A对），以免发生侧穿或底穿。由较突出的髓角处穿孔进入髓腔（B对），髓角处较突出，器械磨除较少牙体组织即可进入髓腔，器械到达髓腔时有落空感。钻针进入髓腔后换用球钻提拉式磨除髓顶（C对），能够使髓腔充分开放。暴露髓室底或根管口。